男，59岁。反复胸痛3天，劳累时发作。休息15分钟或含服硝酸甘油1分钟后可缓解，每天发作3～5次。既往糖尿病史10年。不适宜立即进行的检查是
A. 动态心电图
B. 静息心电图
C. 冠状动脉造影
D. 心电图负荷试验
E. 超声心动图

正确答案：D。心电图负荷试验

解析：老年男性，反复胸痛3天，劳累时发作。休息15分钟或含服硝酸甘油1分钟后可缓解，每天发作3～5次（不稳定性心绞痛），既往糖尿病史10年。根据患者病史和临床表现可以诊断为不稳定性心绞痛和糖尿病，心肌梗死急性期、不稳定型心绞痛、明显心力衰竭、严重心律失常和急性疾病者禁作心电图负荷试验实验（P220），心电图负荷试验为不适宜立即进行的检查（D对）。静息心电图和动态心电图可以帮助诊断，且根据其异常的严重程度和范围，提供预后信息（AB错）（P230）。冠状动脉造影能提供详细血管相关信息，帮助指导治疗，并评价预后（C错）。超声心动图可以帮助诊断，判断疾病严重程度（E错）。